某地区人群一段时间以来出现皮肤瘙痒、腹泻及恶心等消化道症状，你认为水源可能受到哪种物质污染
A. 砷
B. 甲基汞
C. 苯
D. 酚
E. 氰

正确答案：D。酚

解析：本题考查水体污染物。酚是一种有机化合物，它是一种挥发性有机物，具有强烈的刺激性气味，可以溶于水，并且具有腐蚀性。酚（D对ABCE错）可以通过水源污染而进入人体，并引起皮肤瘙痒、腹泻及恶心等消化道症状。酚的污染可以通过工业废水、污水处理厂排放、污染源排放等方式进入水源，从而对人体健康造成危害。